发药时所贴用法用量标签与医嘱不符属于
A. 给药差错
B. 抄写差错
C. 配方差错
D. 处方差错
E. 监测差错

正确答案：C。配方差错

解析：本题考查用药错误。配方差错（C对）是指发药时所贴用法用量标签与医嘱不符。给药差错（A错）是指护士、患者或家属（患者无生活自理能力）将药品给予患者的过程中发生的错误。抄写差错（B错）是护士或下级医生通过抄写把医嘱传递给其它医护人员时发生的转抄错误。处方错误（D错）是医生处方错误。监测差错（E错）是未检查处方的给药方案是否适宜、是否存在问题等，不包含给药途径错误。